根据《基本医疗卫生与健康促进法》，下列关于基本医疗卫生与健康促进的说法，正确的有
A. 基本医疗卫生服务包括基本公共卫生服务和基本医疗服务，基本医疗卫生服务由国家免费提供
B. 公民是自己健康的第一责任人，应树立和践行对自己健康负责的健康管理理念
C. 国家建立健康教育制度，保证公民获得健康教育的权利，提高公民的健康素养
D. 医疗卫生与健康事业应坚持以人民为中心，为人民健康服务，卫生健康工作理念从以治病为中心到以人民健康为中心转变

正确答案：B、C、D。公民是自己健康的第一责任人，应树立和践行对自己健康负责的健康管理理念；国家建立健康教育制度，保证公民获得健康教育的权利，提高公民的健康素养；医疗卫生与健康事业应坚持以人民为中心，为人民健康服务，卫生健康工作理念从以治病为中心到以人民健康为中心转变

解析：本题考查的是基本医疗卫生与健康促进立法。根据《基本医疗卫生与健康促进法》，下列关于基本医疗卫生与健康促进的说法，正确的有公民是自己健康的第一责任人，应树立和践行对自己健康负责的健康管理理念（B对）；国家建立健康教育制度，保证公民获得健康教育的权利，提高公民的健康素养（C对）；医疗卫生与健康事业应坚持以人民为中心，为人民健康服务，卫生健康工作理念从以治病为中心到以人民健康为中心转变（D对）。基本医疗卫生与健康促进立法：2019年12月28日，十三届全国人大常委会第十五次会议通过《中华人民共和国基本医疗卫生与健康促进法》（以下简称《基本医疗卫生与健康促进法》），自2020年6月1日起施行。这是我国卫生与健康领域第一部基础性、综合性的法律，旨在落实《中华人民共和国宪法》（以下简称《宪法》）关于国家发展医疗卫生事业、保护人民健康的规定。这部法律涵盖基本医疗卫生服务、医疗卫生机构和人员、药品供应保障、健康促进、资金保障等方面内容，用法律的形式体现“保基本、强基层、促健康”的理念。2019年《中华人民共和国药品管理法》（以下简称《药品管理法》）修订，其总则第一条，首次将“保护和促进公众健康”作为新的药品管理理念。即药品管理立法目的，是加强药品管理，保证药品质量，保障公众用药安全和合法权益，保护和促进公众健康。1.公民健康权：健康是人生存的基本条件，具体是指人的躯体、精神、社会适应能力的良好状态。健康权是指公民以其机体生理机能正常运作和功能完善发挥，维护人体生命活动的利益为内容的人格权，包括健康维护权和劳动能力以及心理健康。健康权是人类人权中自然拥有的一种权利。《基本医疗卫生与健康促进法》规定，国家和社会尊重、保护公民的健康权。政府有责任制定并不断完善医药卫生政策，创造条件使人人能够尽可能健康。国家实施健康中国战略，普及健康生活，优化健康服务，完善健康保障，建设健康环境，发展健康产业，提升公民全生命周期健康水平。国家建立健康教育制度，保障公民获得健康教育的权利，提高公民的健康素养。公民是自己健康的第一责任人，应树立和践行对自己健康负责的健康管理理念，主动学习健康知识，提高健康素养，加强健康管理。倡导家庭成员相互关爱，形成符合自身和家庭特点的健康生活方式。公民应当尊重他人的健康权利和利益，不得损害他人健康和社会公共利益。2.基本医疗卫生服务：基本医疗卫生服务，是指维护人体健康所必需、与经济社会发展水平相适应、公民可公平获得的，采用适宜药物、适宜技术、适宜设备提供的疾病预防、诊断、治疗、护理和康复等服务。基本医疗卫生服务包括基本公共卫生服务和基本医疗服务（A错）。医疗卫生与健康事业应当坚持以人民为中心，为人民健康服务，卫生健康工作理念从以治病为中心到以人民健康为中心的转变。国家建立基本医疗卫生制度，建立健全医疗卫生服务体系，保护和实现公民获得基本医疗卫生服务的权利。医疗卫生事业应当坚持公益性原则。公民依法享有从国家和社会获得基本医疗卫生服务的权利。基本公共卫生服务由国家免费提供。各级人民政府应当把人民健康放在优先发展的战略地位，将健康理念融入各项政策，坚持预防为主，完善健康促进工作体系，组织实施健康促进的规划和行动，推进全民健身。国家大力发展中医药事业，坚持中西医并重、传承与创新相结合，发挥中医药在医疗卫生与健康事业中的独特作用。